患者外感风寒，恶寒发热，无汗，腹痛，吐泻，舌苔白腻，治疗宜选用
A. 麻黄
B. 桂枝
C. 香薷
D. 防风
E. 白芷

正确答案：C。香薷

解析：恶寒发热，无汗，为外感风寒；腹痛，吐泻，舌苔白腻，为内伤暑湿的表现；用能够发汗解表，化湿和中的香薷治疗（C对）。麻黄的功效是发汗解表，宣肺平喘，利水消肿（A错）。桂枝的功效是发汗解肌，温通经脉，助阳化气，平降冲逆（B错）。防风的功效是祛风解表，胜湿止痛，止痉（D错）。白芷的功效是解表散寒，祛风止痛，宣通鼻窍，燥湿止带，消肿排脓（E错）。